女，8岁。3周前曾患脓疱病，水肿。少尿、肉眼血尿3天，BP150/105mmHg。尿常规：蛋白（+），大量红细胞，管型1～2/HP。ASO升高，血沉增快，血补体C₃下降。首选的降压药是
A. 卡托普利
B. 二氮嗪
C. 硝苯地平
D. 哌唑嗪
E. 硝普钠

正确答案：C。硝苯地平

解析：患儿有脓疱病的感染病史，并且有血尿、蛋白尿（+）、水肿、高血压的临床表现，尿常规检查出ASO升高以及血补体C₃下降，可以诊断该患儿为急性肾小球肾炎。急性肾小球肾炎的降压治疗可选用硝苯地平和卡托普利，但临床更常用的是硝苯地平（C对）（七版诸福棠实用儿科学P1637），而不是卡托普利（A错）。本例虽有高血压，但患儿无头晕、呕吐等症状，不能诊断为高血压脑病，故二氮嗪（B错）及硝普纳（E错）不适合此病例。哌唑嗪（D错）较少用于临床。